充填窝洞时为防止充填物产生悬突应当
A. 层层压紧银汞合金
B. 充填邻面后充填（牙合）面
C. 上成形片和小楔子
D. 挤出银汞合金中的余汞

正确答案：C。上成形片和小楔子

解析：本题考查银汞合金的充填。充填窝洞时为防止充填物产生悬突应当上成形片和小楔子（C对），成形片能够塑造牙的邻面形态，形成正常的邻接；楔子的作用是使成形片紧贴龈壁洞缘的牙颈部，有助于充填体邻面颈部的成形。层层压紧银汞合金，使银汞合金充填更紧密，防止微渗漏或充填体折裂（A错）。双面洞的充填顺序为先填充邻面洞部分，后填（牙合）面洞（B错）。挤出银汞合金中的余汞，会加速银汞合金的凝固，操作时间短，不能及时修整边缘，易形成悬突（D错）。